男，65岁。因肝硬化伴上消化道大出血入院。现患者在病房大喊大叫，随地大小便，有扑翼样震颤。考虑为
A. 肝性脑病
B. 中枢神经系统感染
C. 原发性肝癌
D. 肝肾综合征
E. 肝肺综合征

正确答案：A。肝性脑病

解析：老年男子，因肝硬化伴上消化道大出血入院（肝性脑病的常见诱因），患者在病房大喊大叫，随意大小便，有扑翼样震颤（神经功能失调症状），综上考虑诊断为肝性脑病（A对）。中枢神经系统感染（B错）常常发生昏迷、抽搐、瘫痪、感觉异常、吞咽困难和大小便障碍等症状。原发性肝癌（C错）主要表现为肝大、肝区疼痛、乏力、消瘦、食欲减退、腹胀等症状。肝肾综合征（D错）临床主要表现为少尿、无尿及氮质血症。肝肺综合征（E错）是在肝硬化基础上，排除原发心肺疾病后，出现呼吸困难及缺氧体征如发绀和杵状指（趾）。